面动脉起于
A. 颈内动脉
B. 颈总动脉
C. 颈外动脉
D. 颈总动脉分叉处
E. 锁骨下动脉

正确答案：C。颈外动脉

解析：面动脉起于颈外动脉（C对）约平下颌角处，于咬肌止点的前缘绕过下颌骨下缘至面部，分支分布于下颌下腺、面部和腭扁桃体等。